糖尿病病人应适量增加
A. 钙、锌、铬
B. 钠、钙、锌
C. 磷、钠、铬
D. 磷、钙、碘
E. 碘、钠、钾

正确答案：A。钙、锌、铬